膜半规管
A. 套于同名骨半规管内，靠近半环形骨管的内侧
B. 总骨脚内有一较大膜壶腹
C. 各骨壶腹内有相应的膜壶腹
D. 其管径约为骨半规管的1/2
E. 壶腹壁上有壶腹嵴，它感受直线变速运动

正确答案：C。各骨壶腹内有相应的膜壶腹

解析：骨半规管的前、后半规管的单骨脚合成一个总骨脚（B错）。膜半规管径约为骨半规管的 1/4 - 1/3（D错）。各骨壶腹内有相应膨大的膜壶腹（C对），壁上有隆起的壶腹峭，是位觉感受器，能感受头部旋转变速运动的刺激（E错）。